关于上颌尖牙的解剖特点说法错误的是
A. 尖牙牙根直且粗壮
B. 牙根唇舌径大于近远中径
C. 根颈横切面呈卵圆三角形
D. 根长约为冠长的2倍
E. 牙尖略偏远中

正确答案：E。牙尖略偏远中

解析：上颌尖牙牙根的解剖特点：单根，直且粗壮，唇舌径大于近远中径，根颈横切面呈卵圆三角形。根长约为冠长的2倍，根尖略偏远中。牙尖略偏近中。掌握“上下颌前牙的外形及临床应用解剖”知识点。